妊娠臀位胎位异常可采取的措施是
A. 妊娠28～32周时，采取胸膝卧位
B. 妊娠24～28周时，采取胸膝卧位
C. 妊娠32～36周时，采取胸膝卧位
D. 引产
E. 剖腹产

正确答案：A。妊娠28～32周时，采取胸膝卧位

解析：妊娠30周前，臀先露多可自然回转成头位，妊娠30周后仍为臀位，用膝胸卧位可以纠正，孕妇排空膀胱，松解裤带，胸部贴床，大腿与床成直角，2次/日，每次15分钟，一周后复查（A对）。